不适宜开展普查的情况是
A. 此病有较简便准确的检测手段和方法
B. 对查出的病例有切实的治疗方法
C. 有足够的人力、物力和经费以发现病例和及时普治
D. 对象人群组织严密，不易遗漏
E. 人群中该病的患病率较低

正确答案：E。人群中该病的患病率较低

解析：本题考查普查的缺点。普查的缺点包括：①不适用于患病率低（E对ABCD错）且无简便易行诊断手段的疾病；②工作量大，因此不易细致，难免存在漏查；③调查工作人员涉及面广，掌握调查技术和检查方法的熟练程度不一，对调查项目的理解往往很难统一和标准化，较难保证调查质量；④耗费的人力、物力资源一般较大，费用往往较高。